止于股骨小转子的肌是
A. 臀大肌
B. 臀中肌
C. 臀小肌
D. 髂腰肌
E. 耻骨肌

正确答案：D。髂腰肌

解析：臀大肌（A错）止于髂胫束、臀肌粗隆；臀中肌（B错）和臀小肌（C错）止于股骨大转子；髂腰肌（D对）股骨小转子；耻骨肌（E错）止于股骨的耻骨肌线。